属于胃溶性包衣材料的是
A. 醋酸纤维素
B. 羟丙基甲基纤维素
C. 丙烯酸Ⅱ号
D. 川蜡
E. 邻苯二甲酸二丁酯

正确答案：B。羟丙基甲基纤维素

解析：本题考查片剂的包衣。羟丙基纤维素（B对）是薄膜包衣材料中的胃溶型包衣材料。包衣的基本类型包括糖包衣、薄膜包衣和压制包衣等，其中薄膜包衣又分为胃溶型、肠溶型和水不溶型三种。胃溶型包衣常用的主要有羟丙甲纤维素、羟丙纤维素、丙烯酸树脂Ⅳ号、聚乙烯吡咯烷酮和聚乙烯缩乙醛二乙胺乙酸等；醋酸纤维素（A错）为水不溶性薄膜包衣材料；丙烯酸Ⅱ号（C错）为肠溶型薄膜包衣材料；邻苯二甲酸二丁酯（E错）为常用的增塑剂；川蜡（D错）为糖衣片包衣材料中常用的打光剂。